急性牙髓炎最有效的应急处理方法是
A. 消炎止痛
B. 安抚治疗
C. 开髓引流
D. 调（牙合）磨改
E. 针刺镇痛

正确答案：C。开髓引流

解析：本题考查急性牙髓炎的应急处理方法。急性牙髓炎髓腔压力极高，疼痛剧烈，缓解疼痛最有效的方法是开髓引流（C对），建立炎症引流通道，缓解髓腔内高压。消炎止痛（A错）对牙髓炎和根尖周炎有一定阵痛效果，但在剧烈疼痛的急性牙髓炎，只有局麻下开髓引流或切开排脓才能有效地止痛。安抚治疗（B错）只能暂时缓解疼痛，只要髓腔内高压存在，剧烈疼痛症状还会出现。通过调（牙合）磨改（D错）使患牙咬合降低、功能减轻，得以休息，由创伤引起的牙髓及根尖周症状有可能消除。针刺阵痛（E错）对急性牙髓炎疼痛不能有效缓解。